黑膏药的制备流程
A. 药料提取→炼油→聚合成膏→去“火毒”→摊涂
B. 药料油提取→油丹皂化→下丹成膏→去“火毒”→摊涂
C. 药料提取→炼油→下丹成膏→去“火毒”→摊涂
D. 炸料→油丹皂化→炼油成膏→去“火毒”→摊涂
E. 药料提取→炸料→油丹皂化→去“火毒”→摊涂

正确答案：C。药料提取→炼油→下丹成膏→去“火毒”→摊涂

解析：本题考查黑膏药的制法。黑膏药的制备流程：药料提取→炼油→下丹成膏→去“火毒”→摊涂（C对）。黑膏药的制法：提取药料→炼油→下丹→去“火毒”→摊涂药膏。